避免与辛伐他汀合用的药物是
A. 头孢哌酮
B. 万古霉素
C. 美罗培南
D. 克拉霉素
E. 左氧氟沙星

正确答案：D。克拉霉素

解析：本题考查药物的不良反应。避免与辛伐他汀合用的药物是克拉霉素（D对）。辛伐他汀经过CYP3A4酶代谢，而克拉霉素为肝药酶抑制剂，不能与经过CYP3A4酶代谢药物合用。头孢哌酮（A错）在体内可抑制乙醛脱氢酶，使酒精，即乙醇，在体内转化成乙醛后不能排出，出现“双硫仑样反应”。万古霉素（B错）不宜肌内注射或直接静脉注射。美罗培南（C错）与其它碳青霉烯类和β-内酰胺类抗生素、青霉素和头孢菌素产生局部交叉过敏反应。左氧氟沙星（E错）可引起心脏Q-T间期延长。